关于医疗机构制剂管理的说法，正确的是
A. 医疗机构制剂批准文号和《医疗机构制剂许可证》的有效期均为5年
B. 医疗机构制剂可以在本医院自建网站上向在本院就诊的患者销售，但不得在其他网站上销售
C. 医疗机构不得配制中药、化学药组成的复方制剂
D. 医疗机构制剂可以在本医院周边的药品零售企业凭本医院医师处方销售

正确答案：C。医疗机构不得配制中药、化学药组成的复方制剂

解析：本题考查的是医疗机构制剂管理。关于医疗机构制剂管理的说法，正确的是医疗机构不得配制中药、化学药组成的复方制剂（C对）。医疗机构配制制剂品种范围：医疗机构配制的制剂，应当是本单位临床需要而市场上没有供应的品种。这里的“市场上没有供应的品种”应当包括国内尚未批准上市及虽批准上市但某些性质不稳定或有效期短的制剂，市场上不能满足的不同规格、容量的制剂，临床常用而疗效确切的协定处方制剂，其他临床需要的以及科研用的制剂等。根据《医疗机构制剂注册管理办法（试行）》，有下列情形之一的，不得作为医疗机构制剂申报：市场上已有供应的品种；含有未经国家药品监督管理部门批准的活性成分的品种；除变态反应原外的生物制品；中药注射剂；中药、化学药组成的复方制剂；医疗用毒性药品、放射性药品；其他不符合国家有关规定的制剂。《麻醉药品和精神药品管理条例》第43条规定，对临床需要而市场无供应的麻醉药品和精神药品，持有医疗机构制剂许可证和印鉴卡的医疗机构需要配制制剂的，应当经所在地省级药品监督管理部门批准。《医疗机构制剂许可证》应当标明有效期，有效期为5年，到期重新审查发证。医疗机构制剂批准文号的有效期为3年（A错）。医院自用为主。医疗机构制剂凭执业医师或者执业助理医师的处方在本单位内部使用，并与《医疗机构执业许可证》所载明的诊疗范围一致。医疗机构配制的制剂不得在市场上销售（BD错），不得发布医疗机构制剂广告。特殊情况下，经国务院药品监督管理部门或者省级药品监督管理部门批准，可在指定的医疗机构之间调剂使用。